窦房结是心脏正常起搏点的原因是
A. 静息电位仅﹣70mV
B. 阈电位为﹣40mV
C. 0期去极速度快
D. 没有明显的平台期
E. 4期去极速率快

正确答案：E。4期去极速率快